关于职业病特点的描述，不正确的是
A. 接触水平与发病呈正相关
B. 病因明确
C. 常先后或同时有一定人数发病
D. 发病可以预防
E. 容易治愈

正确答案：E。容易治愈

解析：大多数职业病目前尚缺乏特效治疗方法，如矽肺、石棉肺等，诊断后不容易治愈，所以应加强保护人群健康的预防措施（E错，为本题正确答案）。只有采取有效的预防措施才能减少、消除职业病的发生发展（D对）。引起职业病的病因有特异性而且大多数可以检测（B对）。职业有害因素导致的健康损害一般与接触水平有关，并且在一定范围内存在剂量—反应关系（A对）。职业病往往为群体发病，接触相同因素的同一人群发生相同疾病（C对）。